以下哪条对全冠龈边缘位置设计无影响
A. 固位力大小
B. 美观因素
C. 牙龈的保护
D. 边缘密合
E. 牙体预备操作的难易

正确答案：D。边缘密合

解析：本题考查全冠龈边缘的位置设计。边缘密合（D错，为本题的正确答案）是指全冠边缘与牙体组织的紧密贴合，是每个全冠都必须具备的条件，通过明确的肩台预备、精确的印模取模和制作实现，与龈边缘的位置无关，所以对于全冠龈边缘位置设计无影响。修复体设计时，应综合考虑患者的要求、美观、固位及保护软硬组织等因素。若是全冠修复时，牙体组织缺损较大，需考虑固位力的大小（A对），为了增强固位力，需采用龈下边缘以获得足够的（牙合）龈高度，若是前牙区全冠修复，考虑美观因素（B对），需采用龈下边缘，即边缘止于龈沟内，可以防龋，增进美观，加强固位。若是后牙区全冠修复，对美观要求不高，且考虑对牙龈的保护（C对），可采用龈上边缘，这是因为龈上边缘或与龈缘平齐容易制备，不会损伤牙龈软组织。选择龈边缘形态时，应从三方面考虑：1.边缘形态是否容易预备（E对）；2.边缘形态是否能清晰的反应在印模和代型上；3.边缘应有一定厚度。